依照《药品说明书规范细则（暂行）》的规定复方制剂可免写
A. 通用名
B. 曾用名
C. 商品名
D. 化学名
E. 汉语拼音

正确答案：D。化学名

解析：本题考查化学名。依照《药品说明书规范细则（暂行）》的规定复方制剂可免写化学名（D对）。药物的化学名是根据药品的化学成分确定的化学学术名称。复方制剂可以不列出每个活性成分化学名称、化学结构式、分子式、分子量内容。本项可以表达为“本品为复方制剂，其组分为：×××”。组分按一个制剂单位（如每片、粒、支、瓶等）分别列出所含的全部活性成分及其量。药品通用名（A错）也称为国际非专利药品名称（INN），通常是指有活性的药物物质，而不是最终的药品，因此是药学研究人员和医务人员使用的共同名称。药品的曾用名（B错）是指属原地方标准采用的名称。药品的商品名（C错）通常是针对药物的最终产品，即剂量和剂型已确定的含有一种或多种药物活性成分的药物。